患者，男，30岁。突起呼吸困难，两肺满布以呼气相为主的哮鸣音，无湿啰音，心界不大，心率100次/分，律齐，未闻及心脏杂音。并见咳痰色黄，口渴，面赤，舌红苔黄腻，脉滑数。应首先考虑的治疗药物是
A. β受体激动剂吸入与射干麻黄汤
B. 氨茶碱与玉屏风散
C. 喘定与小青龙汤
D. 异丙肾上腺素与金匮肾气丸
E. 糖皮质激素与定喘汤

正确答案：E。糖皮质激素与定喘汤

解析：患者突起呼吸困难，两肺满布以呼气相为主的哮鸣音，无湿啰音，心界不大，心率100次/分，律齐，未闻及心脏杂音，可诊断为支气管哮喘。热蒸液聚生痰，痰热胶结故见咳痰色黄，病因于热故口渴，面赤；舌红苔黄腻，脉滑数均为热哮证的特点，西医治疗应用糖皮质激素，中医治法为清热宜肺，化痰定喘，方药选用定喘汤加减（E对）。β受体激动剂吸入与射干麻黄汤（A错）可以温肺散寒，化痰平喘，用于治疗支气管哮喘寒哮证。氨茶碱与玉屏风散（B错）可以补肺固肾，用于治疗支气管哮喘肺虚证。喘定与小青龙汤（C错）可以解表散寒，温肺化饮，用于治疗慢性支气管炎外寒里饮证。异丙肾上腺素与金匮肾气丸（D错）可以补肾纳气，用于治疗支气管哮喘肾虚证。